孕妇因恐惧分娩可产生下列变化，错误的是
A. 心率加快
B. 呼吸急促
C. 肺内气体交换不足
D. 产程缩短
E. 体力消耗过多

正确答案：D。产程缩短

解析：虽然分娩是生理现象，但对于产妇确实是一种持久而强烈的应激源。产妇一系列的精神心理因素，能够影响机体内部的平衡、适应力和健康。害怕和恐惧分娩过程，将会对机体产生一系列的变化，如心率加快（A对）、呼吸急促（B对）、肺内气体交换不足（C对），致使子宫缺氧收缩乏力、宫口扩张缓慢、胎先露部下降受阻、产程延长（D错，为本题正确答案）、孕妇体力消耗过多（E对），同时也促使其神经内分泌发生变化，交感神经兴奋，释放儿茶酚胺，血压升高，导致胎儿缺血缺氧，出现胎儿窘迫。